下列属于生理性拮抗的是
A. 酚妥拉明与肾上腺素
B. 肾上腺素拮抗组胺治疗过敏性休克
C. 鱼精蛋白对抗肝素导致的出血
D. 苯巴比妥导致避孕药失效
E. 美托洛尔对抗异丙肾上腺素兴奋心脏

正确答案：B。肾上腺素拮抗组胺治疗过敏性休克

解析：本题考查生理性拮抗。肾上腺素拮抗组胺治疗过敏性休克（B对）属于生理性拮抗。酚妥拉明拮抗肾上腺素对α受体的作用属于竞争特殊受体产生拮抗作用（A错）；鱼精蛋白使肝素的抗凝血作用消失为化学性拮抗（C错）；苯巴比妥导致避孕药失效（D错）与美托洛尔拮抗异丙肾上腺素均属于药理性拮抗（E错）。